神经垂体储存的激素是
A. 皮质醇
B. 泌乳素
C. 肾上腺素
D. 血管加压素
E. 促甲状腺激素释放激素

正确答案：D。血管加压素

解析：神经垂体储存的激素为血管升压素（D对）和缩宫素。皮质醇（A错）为肾上腺皮质分泌的激素。催乳素（B错）为腺垂体分泌。肾上腺素（C错）为肾上腺髓质分泌的激素。促甲状腺激素释放激素（E错）为下丘脑分泌的激素。